好发于患有舍格伦综合征患者的龋病称
A. 隐匿龋
B. 静止龋
C. 猖獗龋
D. 根面龋
E. 环状龋

正确答案：C。猖獗龋

解析：本题考查好发于患有舍格伦综合征患者的龋病。舍格伦综合征又称干燥综合征，其特征表现为外分泌腺的进行性破坏，导致口腔黏膜及结膜干燥，并伴有各种自身免疫性病征。由于唾液腺腺泡萎缩，唾液分泌减少，失去了唾液的清洁、稀释及缓冲作用，龋病的发生率明显增加，且好发猖獗龋（C对）。隐匿龋（A错）是指釉质脱矿常从其表面下层开始，有时可能在看似完整的釉质下方形成龋洞，好发于磨牙沟裂下方和邻面。静止龋（B错）是指龋病发展到某一阶段时，由于病变环境发生改变，龋病不再继续进展，损害扔保留原状，是慢性龋的一种。根面龋（D错）是指根部牙骨质发生的龋病损害，主要发生于牙龈退缩、根面外露的老年人牙列。环状龋（E错）是指前牙唇面、邻面龋较快发展成围绕牙冠的广泛性环形龋，多见于儿童喂养龋。